脂肪酸合成的原料乙酰CoA从线粒体转移至胞液的途径是
A. 三羧酸循环
B. 乳酸循环
C. 葡糖醛酸循环
D. 柠檬酸-丙酮酸循环
E. 丙氨酸-葡萄糖循环

正确答案：D。柠檬酸-丙酮酸循环

解析：脂肪酸合成的原料乙酰CoA从线粒体转移至胞液的途径是柠檬酸-丙酮酸循环（D对）。在此循环中乙酰CoA首先在线粒体内与草酰乙酸缩合成柠檬酸，通过线粒体膜载体转运至胞质；胞质中ATP-柠檬酸裂解酶使柠檬酸裂解释出乙酰CoA及草酰乙酸。进入胞质的乙酰CoA可用以合成脂酸，而草酰乙酸则在苹果酸脱氢酶作用下，还原成苹果酸。苹果酸也可以在苹果酸酶作用下分解为丙酮酸，再转运入线粒体，最终均形成线粒体内的草酰乙酸，再参与转运乙酰CoA。三羧酸循环（A错）是三大营养物质分解代谢产能的共同通路。乳酸循环（B错）是机体利用乳酸的重要途径。糖醛酸循环（C错）的主要生理意义是生成活化的葡萄醛酸-UDPGA。丙氨酸-葡萄糖循环（E错）是将氨从骨骼肌运往肝的重要途径。